修复开始前需要进行的口腔检查是
A. 口腔外部检查
B. 口腔内的检查
C. 制取模型检查
D. X线检查
E. 以上检查均需要

正确答案：E。以上检查均需要

解析：本题考查口腔检查。修复前需要一定的检查，其中口腔检查：口腔外部检查（A对）如颜面部是否对称、颞下颌关节是否有弹响、是否存在张口受限等疾病以确定患者适宜固定修复或可摘修复等。口腔内的检查（B对）如缺牙部位和数目、牙周状况等以确定治疗方案；旧义齿检查、制取模型检查（C对）可帮助医生更好地了解患者的口腔特点，还可对模型进行分析以指导义齿修复过程。X线检查（D对）可帮助医生确定感染及其他病变部位，检查是否有牙根疾患或残根等异物以更好地评估牙周状态。（ABCD均对，故E为本题的正确答案）。